关于磷酸化酶的叙述，错误的是
A. 有a、b两种活性形式
B. 两型可以互相转变
C. 磷酸化酶-a无活性
D. 酶活性受激素调控
E. 是糖原分解的关键酶

正确答案：C。磷酸化酶-a无活性